男，43岁。头部被汽车撞伤5小时，伤后昏迷，20分钟后清醒，醒后不能回忆受伤时的情况，主诉头痛，头晕。入院检查：神清语利，双侧瞳孔等大等圆，对光反射灵敏，四肢活动正常，病理反射阴性，头颅、CT心电图，一切正常。该患者最可能的诊断是
A. 脑挫裂伤
B. 硬膜下血肿
C. 脑震荡
D. 脑干损伤
E. 硬膜外血肿

正确答案：C。脑震荡

解析：男，32岁，头部车祸伤病史，短暂昏迷20分钟后清醒（脑震荡典型表现），入院检查：神清语利，双侧瞳孔等大等圆，对光反射灵敏，四肢活动正常，病理反射阴性，头颅、CT心电图，一切正常（符合脑震荡体查跟影像学表现），故此时需要密切注意的是脑震荡（C对）。